心悸气短加重，神志清，血气分析在正常范围。下列哪项治疗是错误的
A. 抗感染
B. 止咳
C. 祛痰
D. 呼吸兴奋剂
E. 氨茶碱

正确答案：D。呼吸兴奋剂

解析：患者有有慢性支气管炎及肺心病病史，近1周感冒后出现咳嗽，吐黄痰, 心悸气短加重，说明患者肺心病加重，但神志清，血气分析在正常范围，说明患者无呼吸衰竭。呼吸系统感染为引起慢性肺心病急性加重致肺、心功能失代偿的常见原因，故抗感染为肺心病治疗的关键（A对）；止咳（B对）、祛痰（C对）可保持呼吸道通畅，改善呼吸功能；氨茶碱有舒张支气管及气道抗炎作用，可以保持呼吸道通畅，改善呼吸功能（E对）。呼吸兴奋剂适用于呼吸浅表、意识模糊而呼吸道通畅的呼吸衰竭患者，而该患者血气分析在正常范围，无呼吸衰竭，故无需使用呼吸兴奋剂（D错，为本题正确答案）。